按毒物的性质分类，毒物不包括
A. 环境因素
B. 化学因素
C. 物理因素
D. 生物因素

正确答案：A。环境因素

解析：本题考查毒物按性质的分类。毒物是指在一定的条件下，较低的剂量时即可导致机体损害的物质。按毒物的性质分类可包括：化学因素（B对）、物理因素（C对）、生物因素（D对）。环境因素（A错，为本题正确答案）不属于毒物按性质的分类。